《内经》关于区分事物或现象阴阳属性的征兆是
A. 寒热
B. 上下
C. 水火
D. 晦明
E. 动静

正确答案：C。水火

解析：本题是对经典原文的考查。《素问·阴阳应象大论》说：“天地者，万物之上下也；阴阳者，血气之男女也；左右者，阴阳之道路也；水火者，阴阳之征兆也（C对）；金木者，生成之终始也。气有多少，形有盛衰，上下相召，而损益彰矣。”原文里明确指出区分事物或现象阴阳属性的征兆是水火。